可用于制备乳剂的方法有
A. 相转移乳化法
B. 相分离乳化法
C. 两相交替加入法
D. 油中乳化法
E. 水中乳化法

正确答案：C、D、E。两相交替加入法；油中乳化法；水中乳化法